甲是某医疗机构药剂科工作人员，具备执业药师资格。乙是甲的大学同学，担任一家药品批发企业销售经理，同时于2016年3月开办了一家药品零售企业，担任法定代表人兼企业负责人。2019年7月起，乙租用甲执业药师职业资格证书，注册在该药品零售企业，任质量负责人。2021年1月，所在地药品监督管理部门根据举报查实，确认乙开办药品零售企业存在执业药师“挂证”行为。经查，自2019年7月至2021年1月，乙每月支付甲2000元，共计支付3.8万元。该零售药店在此期间共计销售所得154.6万元，其中乙个人所获收入20万元。乙开办的药品零售企业存在执业药师“挂证”行为，适用罚则正确的是
A. 按违反《药品经营质量管理规范》情形进行处罚
B. 按无证经营药品情形进行处罚
C. 按执业药师不在岗未挂牌告知的从重情形进行处罚
D. 按提供虚假证明材料骗取《药品经营许可证》情形进行处罚

正确答案：A。按违反《药品经营质量管理规范》情形进行处罚

解析：本题考查未按规定配备执业药师的法律责任。适用罚则正确的是按违反《药品经营质量管理规范》情形进行处罚（A对）。未按规定配备执业药师的法律责任：根据《执业药师职业资格制度规定》第二十六条规定，对未按规定配备执业药师的单位，由所在地县级以上负责药品监督管理的部门责令限期配备，并按照相关法律法规给予处罚。《国家药监局综合司关于开展药品零售企业执业药师“挂证”行为整治工作的通知》（药监综药管〔2019〕22号）提出在监督检查中发现药品零售企业未按规定配备执业药师的，按照《药品管理法》中未遵守药品经营质量管理规范的法律责任规定进行查处。禁止类行为：药品上市许可持有人从事药品经营活动应当遵循“诚实守信、依法经营”的原则，禁止以任何弄虚作假手段骗取药品经营资格。不得向无合法购药资质的单位或者个人销售药品，尤其是知道或者应当知道他人从事无证经营仍为其提供药品（B错）。经营处方药和甲类非处方药的药品零售企业，执业药师或者其他依法经资格认定的药学技术人员不在岗时，应当挂牌告知，并停止销售处方药和甲类非处方药（C错）。药品批发企业的许可开办药品批发企业（含药品零售连锁企业总部）的，应当向省（区、市）药品监督管理部门申请，经审批同意，依法获取《药品经营许可证》后，方可开展相应药品经营活动（D错）。